男性，30岁。呼吸困难2天就诊，发作前有鼻痒、喷嚏。既往有类似病史。体检：呼吸20次/分，呼气末闻及哮鸣音，心率96次/分，律齐。最可能的诊断是
A. 上呼吸道感染
B. 心源性哮喘
C. 大叶性肺炎
D. 支气管哮喘
E. 喘息性支气管炎

正确答案：D。支气管哮喘